用于去除含热敏性成分中药注射液中热原的方法是
A. 热压灭菌法
B. 高温法
C. 酸碱法
D. 针用活性炭吸附法
E. 0.45μm微孔滤膜滤过法

正确答案：D。针用活性炭吸附法